包绕大脑外侧沟后端的脑回叫
A. 舌回
B. 角回
C. 缘上回
D. 扣带回
E. 颞上回

正确答案：C。缘上回

解析：包绕大脑外侧沟后端的脑回叫缘上回（C对）。舌回（A错）为位于距状沟下方的脑回。角回（B错）为围绕颞上沟后端的脑回。扣带回（D错）为位于扣带沟与胼胝体沟之间的脑回。颞上回（E错）为位于颞上沟上方的脑回。